属于健康观内容的项目是
A. 顸防为主
B. 三级预防
C. 强化社区行动
D. 人人享有卫生保健
E. 群众性自我保健

正确答案：B。三级预防

解析：WHO宪章中，对健康定义为是整个身体、精神和社会生活的完好状态，而不仅仅是没有疾病或不虚弱。它认为健康是一种“状态”，人的健康状况往往波动于健康与疾病之间的过程中。他的积极意义是更全面地考虑到人们的生物、心理与社会因素对健康和疾病的作用，反映了生物-心理-社会医学模式符合现代整体医学模式，这一健康观（预防医学第三版P4）也包括了综合性保健观念的三级预防（B对）。